各级各类医疗保健机构应当设立预防保健组织或者人员承担
A. 本单位的传染病预防、控制和疫情管理工作
B. 责任地段的传染病监测管理工作
C. 本单位和责任地段的传染病监测管理工作
D. 本单位和责任地段的传染病预防、控制和疫情管理工作
E. 本单位和责任地段的传染病监督、监测管理工作

正确答案：D。本单位和责任地段的传染病预防、控制和疫情管理工作

解析：医疗救治时认真履行职责主要包括：①各级各类医疗机构应当设立预防保健组织或者人员，承担本单位和责任地段的传染病预防、控制和疫情管理工作（D对），履行规定职责。②医疗机构应当执行卫生部关于医院感染管理规范、医院消毒卫生标准等有关规定，采取严格的防护措施，使用有效防护用品，防止医务人员感染。③医务人员应当增强传染病防治的法律意识，接受专门的业务培训，遵守操作常规，按照有关规定做好个人防护。